癫痫大发作首选
A. 丙戊酸钠
B. 苯妥英钠
C. 乙琥胺
D. 苯巴比妥
E. 卡马西平

正确答案：B。苯妥英钠

解析：本题考查抗癫痫药。癫痫大发作的首选药是苯妥英钠（B对）。癫痫是一种慢性发作性神经症状，是大脑神经元高度异常放电导致反复发作的短暂的脑功能紊乱。苯妥英钠用于治疗强直-阵挛性发作（精神运动性发作、颞叶癫痫）、单纯及复杂部分性发作（局限性发作）、继发性全面发作和癫痫持续状态；可用于治疗三叉神经痛、隐性营养不良性大疱性表皮松懈症、发作性舞蹈手足徐动症、发作性控制障碍（包括发怒、焦虑和失眠的兴奋过渡等的行为障碍疾患）、肌强直症及三环类抗抑郁药过量时心脏传导障碍等；适用于洋地黄中毒所致的室性及室上性心律失常。卡马西平（E错）用于治疗癫痫、躁狂症、三叉神经痛、神经源性尿崩症、糖尿病神经病变引起的疼痛；预防或治疗躁郁症。丙戊酸钠（A错）为广谱的抗癫痫药，用于各种类型的癫痫、包括全身性强直性-阵挛发作及部分性发作；尚可用于双相情感障碍相关的躁狂发作，但毒性较大。苯巴比妥（D错）为镇定、催眠药，也可用于癫痫大发作和癫痫持续发作的治疗。乙琥胺（C错）为癫痫小发作首选。